男性，25岁，昏睡在路边被警察送到医院。急诊体检：深昏迷状态，呼吸有轻度大蒜味，疑为有机磷酸中毒，下列对诊断最有帮助的是
A. 瞳孔缩小
B. 大小便失禁
C. 肌肉抽动
D. 呕吐物有大蒜味
E. 全血胆碱酯酶活力降低

正确答案：E。全血胆碱酯酶活力降低

解析：有机磷农药中毒机制是有机磷农药进入人体后，抑制胆碱酯酶活性，使组织内乙酰胆碱沉积过多，胆碱能受体发生活性紊乱导致器官出现障碍，使部分腺体兴奋性增高而引起的一系列症状，如多汗、恶心、呼吸困难等（E对）；瞳孔缩小、大小便失禁、肌肉抽动、呕吐物有大蒜味均是有机磷中毒会出现的症状，但不是其诊断指标（ABCD错）。